下列关于翼腭窝的叙述中，不正确的是
A. 前界为上颌骨体部
B. 后界为蝶骨翼突
C. 向后上经切牙孔通颅腔
D. 向下经翼腭管通口腔
E. 位于眶尖的下方、颞下窝的内侧

正确答案：C。向后上经切牙孔通颅腔

解析：翼腭间隙（翼腭窝）位于眶尖的下方、颞下窝的内侧。前界为上颌骨体部，后界为蝶骨翼突，上为蝶骨大翼，内以腭骨垂直板为界。间隙内主要有上颌神经、蝶腭神经节、上颌动脉及其分支。翼腭间隙向前经眶下裂通眼眶，向内经蝶腭孔通鼻腔，向外经翼上颌裂通颞下间隙，向下经翼腭管通口腔，向后上经圆孔通颅腔。掌握“面侧深区及颌面部各间隙的境界”知识点。